属于分析性研究的是
A. 疾病监测
B. 队列研究
C. 临床试验
D. 临床指南
E. 系统评价

正确答案：B。队列研究

解析：本题考查分析性研究的类型。分析性研究包括队列研究（B对）和病例对照研究（ACDE错）。